变异性心绞痛患者首选药物是
A. 胺碘酮
B. ACEI
C. 利多卡因
D. 硝苯地平
E. 普萘洛尔

正确答案：D。硝苯地平

解析：变异性心绞痛是由于冠状动脉痉挛所致的血流减少引起，而钙通道阻滞剂硝苯地平（D对）可扩张冠状动脉，增加冠状动脉流量，故是治疗变异性心绞痛的首选药物。胺碘酮（A错）主要用于心律失常的治疗。ACEI（B错）是肾素血管紧张素酶抑制药，主要用于高血压及心衰的治疗。利多卡因（C错）主要用于室性心律失常的治疗。普萘洛尔（E错）是β受体阻滞剂，主要用于高血压及心梗的治疗。